关于人体试验的知情同意，下列说法中不正确的是
A. 科研人员将有关信息告知受试者
B. 受试者能够理解信息的内容
C. 受试者具有自主能力
D. 受试者自由决定同意
E. 受试者的同意表示不可更改

正确答案：E。受试者的同意表示不可更改